男，75岁，尿流变细排尿困难2年，尿失禁半年，超声：前列腺增生，膀胱余尿500毫升，患者尿失禁的类型是
A. 急迫性尿失禁
B. 充溢性尿失禁
C. 真性尿失禁
D. 混合性尿失禁
E. 压力性尿失禁

正确答案：B。充溢性尿失禁

解析：该患者男，75岁，出现尿流变细排尿困难，尿失禁半年，超声：前列腺增生，膀胱余尿500毫升，诊断为慢性尿储留，提示为充盈性尿失禁（B对）。